关于感染性流产的处理。下列何项是错误的
A. 立即刮宫以清除宫腔内容物，同时给广谱抗生素
B. 原则上先给抗生素控制感染，再行刮宫
C. 出血多者在静脉应用抗生素同时取出宫内大块残留，以减少出血，感染控制后再行清宫术
D. 患者出现感染性休克，应积极抗休克
E. 如出现盆腔脓肿应作切开引流术

正确答案：A。立即刮宫以清除宫腔内容物，同时给广谱抗生素

解析：题中问哪项不正确，选项A不正确。治疗原则应积极控制感染，若阴道流血不多，应用广谱抗生素2～3日，待控制感染后再行刮宫，清除宫腔残留组织以止血。若阴道流血量多，静脉滴注广谱抗生素和输血的同时，用卵圆钳将宫腔内残留组织夹出，使出血减少，切不可用刮匙全面搔刮宫腔，以免造成感染扩散。术后继续应用抗生素，待感染控制后再行彻底刮宫。掌握“自然流产”知识点。